苦参含草酸钙
A. 簇晶
B. 方晶
C. 针晶
D. 砂晶
E. 柱晶

正确答案：B。方晶